肺泡通气不足容易造成的酸碱失衡是
A. 呼碱
B. 呼酸合并代碱
C. 代碱
D. 呼酸合并代酸
E. 呼酸

正确答案：E。呼酸

解析：Ⅱ型呼吸衰竭即高碳酸症性呼吸衰竭，血气分析特点是PaO₂<60mmHg,同时伴有PaCO₂＞50mmHg，系肺泡通气不足所致。从而导致呼吸性酸中毒（E对）。